单纯小脑幕裂孔疝的临床症状不包括
A. 昏迷
B. 呕吐
C. 偏瘫
D. 双侧瞳孔大小多变
E. 病侧瞳孔散大

正确答案：D。双侧瞳孔大小多变

解析：小脑幕切迹疝（又称颞叶钩回疝）指颅内压增高使颞叶海马回、钩回通过小脑幕切迹被推移至幕下。单纯小脑幕裂孔疝可表现为：①颅内压增高引起的头痛、呕吐（B对）症状；②颞叶钩回、海马回向下移位使动眼神经受牵拉，引起患侧瞳孔一过性缩小，之后动眼神经麻痹，患侧瞳孔逐渐散大（E对），直接和间接对光反射消失；③移位的颞叶组织压迫中脑，引起嗜睡、昏迷（A对），并可出现对侧肢体瘫痪（C对），肌力减退，肌张力增高，病理征阳性等症状。单纯小脑幕裂孔疝的临床症状不包括双侧瞳孔大小多变（D错，为本题正确答案）。枕骨大孔疝患者，因脑干缺氧，可出现瞳孔忽大忽小。